“长正中”所指的滑动距离为
A. 由牙尖交错位自如滑到下颌后退接触位
B. 由牙尖交错位向前滑到下颌后退接触位
C. 由下颌后退接触位向后滑到牙尖交错位
D. 由牙尖交错位自如地直向前滑动到下颌后退接触位
E. 由下颌后退接触位自如地直向前滑动到牙尖交错位

正确答案：E。由下颌后退接触位自如地直向前滑动到牙尖交错位

解析：确定正中关系（牙合）（后退接触位）后能自如地直向前滑动到牙尖交错位（如有偏斜不超过0.5mm），其滑动距离多在0.5～1.0mm，这一距离称为长正中。掌握“下颌姿势位、三类颌位与前伸、侧方（牙合）颌位”知识点。